大气污染对健康的间接危害不包括
A. 臭氧层破坏
B. 酸雨
C. 温室效应
D. 大气能见度降低
E. 机体免疫力降低

正确答案：E。机体免疫力降低

解析：本题考查大气污染对健康的间接危害。大气污染对健康的间接危害有：1.温室效应（C对）：气候变暖可导致一些经昆虫传播或介水传播的疾病流行范围扩大，也可导致与暑热相关的疾病发病率和死亡率增加。2.臭氧层破坏（A对）：臭氧层被破坏形成空洞以后，减少了臭氧层对紫外线和其他宇宙射线的吸收阻挡功能，造成人群皮肤癌和白内障等发病率的增加。3.酸雨（B对）：酸雨增加土壤中有害金属的溶解度，加速其向水体、植物和农作物的转移。4.大气棕色云团：在大气污染严重的地区，儿童佝偻病的发病率较高，某些通过空气传播的疾病易于流行。大气污染还能降低大气能见度（D对），使交通事故增加。5.影响居民的生活卫生条件：例如灰尘使环境污秽，恶臭或刺激性气体可影响居民开窗换气，以及晾晒衣物等。机体免疫力降低（E错，为本题正确答案）不属于大气污染对健康的间接危害。